谷类中含量较丰富的维生素是
A. 硫胺素（维生素B₁）和烟酸（维生素B₃）
B. 硫胺素和抗坏血酸
C. 烟酸和胡萝卜素
D. 维生素A和维生素D
E. 抗坏血酸和胡萝卜素

正确答案：A。硫胺素（维生素B₁）和烟酸（维生素B₃）